女，22岁。右手及前臂沸水烫伤1小时。查体：右手及前臂红肿胀明显，有水疱，部分水疱皮脱落，可见创面红白相间，疼痛迟钝。该患者烧伤深度及严重程度分度是
A. 深Ⅱ°，中度烧伤
B. 浅Ⅱ°，中度烧伤
C. 浅Ⅱ°，轻度烧伤
D. 深Ⅱ°，轻度烧伤
E. 深Ⅱ°，重度烧伤

正确答案：D。深Ⅱ°，轻度烧伤

解析：该患者右手及前臂沸水烫伤，红肿胀明显，有水疱，部分水疱皮脱落，可见创面红白相间，疼痛迟钝，可判断烧伤程度为深Ⅱ度烧伤，根据中国新九分法，计算该患者烧伤面积占体表积的百分比是5.5%，小于10%，为轻度烧伤（D对）。